慢性胃炎的临床表现一般不包括
A. 恶心、呕吐
B. 反酸、烧心
C. 贫血
D. 右季肋部痛
E. 上腹部痛

正确答案：D。右季肋部痛

解析：慢性胃炎患者可表现为中上腹不适（E对）、饱胀、钝痛、烧灼痛等，也可呈食欲不振，恶心、呕吐（A对）、反酸、烧心（B对）等消化不良症状。体征多不明显，有时上腹轻压痛。贫血（C对）常见于A型胃炎（慢性萎缩性胃体胃炎）患者。A型萎缩性胃炎病变部位主要在胃底和胃体，血中抗壁细胞抗体和内因子抗体阳性，VitB₁₂吸收障碍，DNA合成障碍，产生巨幼细胞性贫血。右季肋部痛（D错，为本题正确答案）是肝脏疾病的临床表现。